男，40岁。因剧烈腹痛2小时，急诊入院。入院时，心电图显示心房纤颤。查体：腹部平坦，较软，直肠指诊无粘液血便。下列对于确诊最有意义的检查是
A. 腹部X线平片
B. 腹部超声检查
C. 腹部CT
D. 腹部动脉造影
E. 钡剂灌肠造影

正确答案：D。腹部动脉造影

解析：患者为中年男性，因剧烈腹痛2小时（提示有急腹症存在可能），急诊入院。入院时，心电图显示心房纤颤（房颤提示可能合并血栓形成，脱落可形成栓子造成动脉阻塞）。查体，腹部平坦，较软（无腹膜炎体征），直肠指诊无粘液血便（排除直肠部位损伤），综合患者病史、查体，最有可能的诊断是肠系膜上动脉栓塞，肠系膜上动脉栓塞的栓子多来自心脏，如心肌梗死后的壁栓，心瓣膜病、心房纤颤、心内膜炎等，一般发病急骤，早起表现为突然发生剧烈的腹部绞痛，可以是全腹性或局限性。对于肠系膜上动脉栓塞患者，确诊最有意义的检查是腹部动脉造影（D对）。腹部动脉造影可以明显反映动脉栓塞存在与否以及存在的部位，准确率高，对于后期的治疗亦有帮助。腹部X线平片（A错）主要用于胃十二指肠穿孔的诊断；腹部超声检查（B错）主要用于腹腔实质脏器的检查；腹部CT（C错）可以清楚反应腹部内脏器的受损情况；钡剂灌肠造影（D错）是消化道病变的常用检查方法。以上四种检查方法，都不如腹腔动脉造影能够直接反映肠系膜上动脉栓塞患者的血管栓塞情况。